女，28岁，初孕妇。妊娠40周，规律宫缩8小时，查体：P90次/分，BP140/80mmHg，宫口7cm，先露S+1，胎心140次/分。10分钟后胎膜破裂，流出清亮液体。正确的处理方法是
A. 立即静脉滴注硫酸镁
B. 立即静脉滴注缩宫素
C. 立即行剖宫产
D. 立即静脉滴注地塞米松
E. 立即听胎心

正确答案：E。立即听胎心

解析：28岁初孕妇，足月妊娠，宫缩8小时，宫口7cm，先露S=+1，胎心140次/分。各项指标正常，流出清亮液体提示胎膜破裂，一旦胎膜破裂，应立即监测胎心（E对），并观察羊水性状（颜色和流出量），记录破膜时间，测量体温。静脉滴注硫酸镁用于治疗子痫（A错）。该产妇目前有规律宫缩8小时，宫口7cm在正常范围，不需要缩宫素（B错）。该产妇目前各项指标均在正常范围，无剖宫产术指征（C错）。注射地塞米松（D错）为早产儿促胎肺成熟的处理方法。